白故纸的正名是
A. 白芷
B. 蛇蜕
C. 蝉蜕
D. 补骨脂
E. 木蝴蝶

正确答案：E。木蝴蝶

解析：本题考查的是饮常见的饮片正名与相关别名。白故纸的正名是木蝴蝶（E对）。木蝴蝶别名：玉蝴蝶、千张纸、云故纸、白故纸。白芷（A错）别名：杭白芷、香白芷。蛇蜕（B错）别名：龙衣。蝉蜕（C错）别名：蝉衣、蝉退。补骨脂（D错）别名：破故纸。